胆囊动脉通常发自
A. 肝固有动脉
B. 肝固有动脉右支
C. 肝固有动脉左支
D. 肝总动脉
E. 腹腔干

正确答案：B。肝固有动脉右支

解析：肝固有动脉入肝门前分为肝左支和肝右支分布于肝，肝固有动脉右支（B对）发出胆囊动脉分布于胆囊。